噻嗪类利尿药的禁忌证
A. 高钾血症
B. 痛风
C. 体位性低血压
D. 双侧肾动脉狭窄
E. 2-3度房室传导阻滞

正确答案：B。痛风

解析：本题考查噻嗪类利尿药的禁忌证。噻嗪类利尿药的禁忌证是痛风（B对）。噻嗪类利尿药禁用于对本类药或含有磺酰胺基团药过敏者有、痛风患者、低钾血症者（A错）、无尿或肾衰竭者。体位性低血压（C错）是α受体阻断剂的禁忌证。双侧肾动脉狭窄（D错）是ACEI类药物的禁忌证。2-3度房室传导阻滞（E错）是非二氢吡啶类钙通道阻滞剂的禁忌证。